PFM全冠肩台的宽度一般为
A. O.5mm
B. 1.0mm
C. 1.5mm
D. 2mm
E. 2.5mm

正确答案：B。1.0mm

解析：本题考查PFM全冠肩台的宽度。铸造金属全冠与牙体组织密合、固位力强、自身强度高，但因美观度差主要用于后牙。全瓷冠适应症广泛，在理化、生物美学上显示出比金瓷修复体更大的优势，但预备量较大。烤瓷熔附金属全冠（PFM）兼金属全冠的强度和烤瓷全冠的美观，其颜色、外观逼真，色泽稳定，表面光滑，耐磨性强，不易变形，抗折力强具有一定的耐腐蚀性。有学者通过测量模型得出肩台预备量在1.00mm（B对）属于安全范围。而且根据统计肩台在1.2mm以上，如1.5mm （C错）、2mm （D错）牙发生露髓概率增加且不符合保留足够的牙体组织，减少患牙破坏，获得修复体远期疗效的治疗修复原则，若肩台预备2.5mm（E错）极易露髓且破坏组织太多。